患者，男，54岁。右胁下痞块，推之不移，按之刺痛固定此为
A. 虫积
B. 气鼓
C. 水鼓
D. 癥积
E. 瘕聚

正确答案：D。癥积

解析：若腹部有肿块，凡肿块按之有形，推之不移，痛有定处者，为癥积（D对）。虫积常见若腹中结块，按之起伏聚散，往来不定，或按之形如条索状，久按转移不定，或按之手下如蚯蚓蠕动者（A错）。两手分置于腹部两侧对称位置，一手轻轻叩拍腹壁，另一手无波动感，以手叩击如鼓之膨膨然者为气鼓（B错）。两手分置于腹部两侧对称位置，一手轻轻叩拍腹壁，另一手若有波动感，按之如囊裹水者为水鼓（C错）。若腹部有肿块，凡肿块推之可移，或痛无定处，聚散不定者，为瘕聚（E错）。